常见不良反应为泌尿生殖系统感染的口服降糖药物是
A. 沙格列汀
B. 达格列净
C. 吡格列酮
D. 二甲双胍
E. 瑞格列奈

正确答案：B。达格列净

解析：本题考查口服降糖药。常见不良反应为泌尿生殖系统感染的口服降糖药物是达格列净（B对）。达格列净属于钠-葡萄糖协同转运蛋白-2（SGLT-2）抑制药，SGLT-2抑制剂的常见不良反应为生殖泌尿道感染。沙格列汀（A错）为二肽基肽酶-4（DPP4）抑制剂，DPP-4抑制剂总的耐受性良好。①常见咽炎、鼻炎、上呼吸道感染、泌尿道感染。另可常见腹泻、肌痛、关节痛、高血压。②偶见轻度肝酶升高、碱性磷酸酶降低、急性胰腺炎。③单独使用DPP-4抑制剂不增加低血糖发生的风险。吡格列酮（C错）属于噻唑烷二酮类胰岛素增敏剂，噻唑烷二酮类药物的使用因其不良反应而受限，常见贫血、血红蛋白降低、血容量增加、血细胞比容降低、血红蛋白降低，在开始治疗后4～12周更为明显。二甲双胍（D错）为双胍类口服降糖药，常见腹泻、腹痛、食欲减退、厌食、胃胀、乏力、口苦、金属味、腹部不适；少见味觉异常、大便异常、低血糖反应。瑞格列奈（E错）属于非磺酰脲类胰岛素分泌促进剂，吸收快、起效快，作用时间短，既可降低空腹血糖，又可降低餐后血糖，无需餐前0.5h服用，因而又称为“餐时血糖调节剂”。